患者半年来因右侧后牙咬合痛、冷热痛要求治疗。查：右上6无龋，近中可疑隐裂，冷热测引起疼痛，刺激去除后，持续数秒，叩诊（±）。右侧后牙不同程度磨损，探敏。该患者主诉牙治疗原则为
A. 不治疗
B. 调（牙合）
C. 脱敏
D. 牙髓治疗后全冠修复
E. 备洞充填

正确答案：D。牙髓治疗后全冠修复

解析：本题考查牙隐裂的防治原则。患者半年来因右侧后牙咬合痛、冷热痛要求治疗。查：右上6无龋，近中可疑隐裂，冷热测引起疼痛，刺激去除后，持续数秒，叩诊（±）。右侧后牙不同程度磨损，探敏。该患者主诉牙治疗原则为牙髓治疗后全冠修复（D对）。患牙冷热测引起疼痛，刺激去除后，持续数秒，牙髓已有炎症反应。牙隐裂累及牙髓，应做牙髓治疗，治疗后及时进行冠修复，以防止牙齿折裂。患牙已累及牙髓，若不治疗，会使炎症进一步加重（A错）。调（牙合）是对已发生隐裂牙的治疗，也是预防其他牙齿发生隐裂的措施，该患牙已发生隐裂，且累及牙髓，对该患牙进行调牙合的目的是防止裂线加深，并不是该牙的治疗原则（B错）。脱敏主要用于治疗牙本质敏感（C错）。裂线达牙本质浅层、中层的患牙，应进行备洞充填（E错）。